心衰时心脏扩张从代偿转向失代偿的关键因素是
A. 肌节长度小于2.2μm
B. 肌节长度达到2.2μm
C. 肌节长度达到Lmax
D. 肌节长度超过Lmax
E. 心室舒张末期压力小千1.33kPa

正确答案：D。肌节长度超过Lmax

解析：心衰时，心脏每搏输出量减少，心室舒张末期容积（前负荷）增加，使代偿期的心肌肌节初长度增大但不超过2.2μm（产生最大收缩力时的肌节长度，也称Lmax），心肌收缩力增强。若长期前负荷过重，心室扩张使心肌肌节长度超过Lmax（D对）时，粗细肌丝不能充分重叠，有效横桥的数目减少，心肌收缩力降低，心脏扩张从代偿期转向失代偿期。